下列药物，不能用于艾滋病治疗的是
A. 齐多夫定
B. 双脱氧胞苷
C. 双脱氧肌苷
D. 阿糖腺苷
E. 拉米夫定

正确答案：D。阿糖腺苷

解析：目前抗HIV的药物分为六类30余种，分为核苷类反转录酶抑制剂、非核苷类反转录酶抑制剂、蛋白酶抑制剂、融合抑制剂、整合抑制剂、CCR5抑制剂。齐多夫定（A对）、双脱氧胞苷（B对）、双脱氧肌苷（C对）、目前抗HIV的药物分为六类30余种，分为核苷类反转录酶抑制剂、非核苷类反转录酶抑制剂、蛋白酶抑制剂、融合抑制剂、整合抑制剂、CCR5抑制剂。齐多夫定（A对）、双脱氧胞苷（B对）、双脱氧肌苷（C对）、拉米夫定（E对）均属于核苷类反转录酶抑制剂，抑制艾滋病病毒反转录。阿糖腺苷（D错，为本题正确答案）。主要用于疱疹病毒感染的治疗，对艾滋病无效。